关于医疗用毒性药品使用和调配要求的说法，错误的是
A. 具有毒性药品经营资格的药品零售企业可以从事毒性药品调配工作
B. 对处方未注明“生用”的毒性中药，应当付炮制品
C. 调配毒性药品时，每次处方剂量不得超过二日常用量
D. 处方一次有效，取药后处方保存二年备查

正确答案：C。调配毒性药品时，每次处方剂量不得超过二日常用量

解析：本题考查医疗用毒性药品生产、经营要求。零售药店供应和调配毒性药品，凭盖有医生所在的医疗单位公章的正式处方。每次处方剂量不得超过二日极量（C错，为本题正确答案）。零售药店供应和调配毒性药品，凭盖有医生所在的医疗单位公章的正式处方。每次处方剂量不得超过二日极量。毒性药品的收购和经营，由药品监督管理部门指定的药品经营企业承担，其他任何单位或者个人均不得从事毒性药品的收购、经营业务（A对）。医疗机构供应和调配毒性药品，对处方未注明“生用”的毒性中药，应当付炮制品（B对）。如发现处方有疑问时，须经原处方医生重新审定后再行调配。处方一次有效，取药后处方保存2年备查（D对）。